AIDS的临床表现不包括
A. 隐性感染
B. 原发急性感染
C. 无症状潜伏感染
D. AIDS相关综合征
E. 典型AIDS

正确答案：A。隐性感染